药品经营企业销售劣药，应没收违法销售药品和违法所得，并处违法销售药品
A. 货值金额三倍以上五倍以下的罚款
B. 货值金额十倍以上二十倍以下的罚款
C. 货值金额百分之五十以上三倍以下的罚款
D. 货值金额五倍以上七倍以下的罚款
E. 货值金额二倍以上五倍以下的罚款

正确答案：B。货值金额十倍以上二十倍以下的罚款

解析：本题考查生产、销售、使用劣药的行政责任。药品经营企业销售劣药，应没收违法销售药品和违法所得，并处违法销售药品货值金额十倍以上二十倍以下的罚款（B对）。生产、销售、使用劣药的行政责任：1.单位承担的行政责任：根据《药品管理法》第一百一十七条规定，生产、销售劣药的，没收违法生产、销售的药品和违法所得，并处违法生产、销售的药品货值金额十倍以上二十倍以下的罚款；违法生产、批发的药品货值金额不足十万元的，按十万元计算，违法零售的药品货值金额不足一万元的，按一万元计算；情节严重的，责令停产停业整顿直至吊销药品批准证明文件、药品生产许可证、药品经营许可证或者医疗机构制剂许可证。生产、销售的中药饮片不符合药品标准，尚不影响安全性、有效性的，责令限期改正，给予警告；可以处十万元以上五十万元以下的罚款。2.个人承担的行政责任：根据《药品管理法》第119条的规定，药品使用单位使用假药、劣药的，按照销售假药、零售劣药的规定处罚；情节严重的，法定代表人、主要负责人、直接负责的主管人员和其他责任人员有医疗卫生人员执业证书的，还应当吊销执业证书。3.从重处罚的情节：根据《药品管理法》第一百三十七条规定，生产、销售劣药，有下列行为之一的，由药品监督管理部门在《药品管理法》和《药品管理法实施条例》规定的处罚幅度内从重处罚：①生产、销售以孕产妇、儿童为主要使用对象的劣药；②生产、销售的生物制品属于劣药；③生产、销售劣药，造成人身伤害后果；④生产、销售劣药，经处理后再犯；⑤拒绝、逃避监督检查，伪造、销毁、隐匿有关证据材料，或者擅自动用查封、扣押物品。